肺气肿时，心脏浊音界的改变多为
A. 心浊音界向左扩大
B. 心浊音界缩小
C. 心浊音界向右扩大
D. 心浊音界向两侧扩大
E. 以上均非

正确答案：B。心浊音界缩小

解析：临床通常所说心浊音界是指：左右心缘被肺遮盖部分，在心脏叩诊时呈现的相对浊音界。叩诊音受肺含气量、胸壁厚薄及邻近器官的影响。肺气肿时，肺内含气量增多，心脏浊音界的改变多为心浊音界缩小（B对）。心浊音界向左扩大（A错）见于左心室增大、左心房增大，常见疾病有主动脉瓣关闭不全、二尖瓣狭窄等。心浊音界向右扩大（C错）多见于右心室增大，常见疾病有肺心病或房间隔缺损等。心浊音界向两侧扩大（D错）见于左、右心室增大、心包积液，常见疾病有扩张型心肌病等。